多形性腺瘤最常见于
A. 腮腺
B. 腭腺
C. 唇腺
D. 舌下腺
E. 下颌下腺

正确答案：A。腮腺

解析：多形性腺瘤最常见于腮腺，其次为下颌下腺，舌下腺极少见。掌握“黏液表皮样癌”知识点。